低渗性脱水与高渗性脱水相比那一项不对：
A. 低渗性脱水主要是失钠大于失水
B. 两者都有有效循环血量的减少
C. 高渗性脱水比低渗性脱水更易发生休克
D. 低渗性脱水比高渗性脱水更易发生休克
E. 均有体液容量的减少

正确答案：C。高渗性脱水比低渗性脱水更易发生休克

解析：低渗性脱水主要是失钠大于失水（A对），高渗性脱水主要是失水大于失钠，两者都有细胞外液丢失，引起体液容量和循环血量的减少（BE对）。低渗性脱水时细胞外液的水向渗透压相对高的细胞内转移，加重细胞外液水的丢失，易发生休克（D对C错，为本题正确答案）。